动物每食入100g饲料所增加的体重克数为
A. 食物利用率
B. 脏器系数
C. 病理学检查
D. 一般性指标
E. 特异性指标

正确答案：A。食物利用率